关于原核RNA聚合酶叙述，正确的是
A. 原核RNA聚合酶有3种
B. 由4个亚基组成的复合物
C. 全酶中包括一个σ因子
D. 全酶中包括两个β因子
E. 全酶中包括一个a因子

正确答案：C。全酶中包括一个σ因子